男性，43岁。右上第二前磨牙金属烤瓷冠修复，修复体粘固3天，持续冷热刺激敏感，最可能的原因是
A. 戴冠时机械刺激
B. 邻面接触紧密
C. 游离磷酸的刺激
D. 龋坏组织未去净
E. 有咬合高点

正确答案：C。游离磷酸的刺激

解析：本题考查修复体戴入后的问题及处理。持续地对冷热刺激敏感，表明牙髓处于充血状态。而戴冠时的机械刺激在短时间内可以缓解，邻面接触过紧可以引起修复的牙齿与邻牙的持续性胀痛，并不是牙髓疼痛，龋坏组织未去净长时间后可以导致牙齿出现牙髓炎的症状，咬合高点会出现牙齿咬合痛的症状，最有可能的原因为游离磷酸的刺激，可能导致被修复的基牙出现持续性的刺激敏感。